胆汁可以促进脂肪的消化和吸收，主要是由于它含有
A. 脂肪酶
B. 胆红素
C. 胆绿素
D. 胆盐
E. 胆固醇

正确答案：D。胆盐

解析：胆汁中含有水、胆盐、卵磷脂、胆固醇和胆色素等有机物和Na⁺、K⁺、Ca²⁺、HCO₃⁻等无机物，但不含有消化酶（A错）。其中促进消化吸收的主要成分是胆盐（D对）。胆盐、胆固醇（E错）、卵磷脂可作为乳化剂，降低脂肪表面张力，从而促进脂肪消化分解，但胆固醇、卵磷脂作用不及胆盐重要。胆红素（P195）（B错）和胆绿素（C错）属于胆色素，决定胆汁的颜色，但与消化吸收无关。